产妇在胎盘娩出前禁止使用的药物是
A. 麦角新碱注射液
B. 乳糖酸红霉素注射液
C. 头孢唑啉钠注射液
D. 5%葡萄糖注射液
E. 氨甲苯酸注射液

正确答案：A。麦角新碱注射液